新的公共卫生方法的精髓是
A. 健康教育
B. 健康促进
C. 卫生宜教
D. 预防接种
E. 卫生宣教

正确答案：B。健康促进